新生儿出血选用的止血药是
A. 维生素K
B. 氨甲苯酸
C. 垂体后叶素
D. 肝素
E. 华法林

正确答案：A。维生素K